在固有免疫系统中，能够对细菌、微生物等进行吞噬杀伤的细胞是
A. 中性粒细胞
B. 角质细胞
C. 肥大细胞
D. NK细胞
E. B细胞

正确答案：A。中性粒细胞

解析：固有免疫系统的中性粒细胞和单核巨噬细胞可对细菌等微生物进行吞噬杀伤。掌握“免疫应答基本概念、固有及适应性免疫应答”知识点。